某女，32岁，平素性情急躁易怒，月经不调，因胃痛1周就诊，胃脘灼痛，痛势急迫，烧心泛酸，口苦口干，舌红苔黄，脉弦。该患者弦脉提示病位相关之脏是
A. 肝
B. 心
C. 脾
D. 肺
E. 肾

正确答案：A。肝

解析：本题考查的是弦脉的主病。该患者弦脉提示病位相关之脏是肝（A对）。弦脉与主病：［脉象］端直以长，如按琴弦。［主病］肝胆病、痛证、痰饮等。弦大兼滑，阳热为病；弦紧兼细，阴寒为病；虚劳内伤，中气不足，肝病乘脾，也常见弦脉；若弦而细劲，如循刀刃，便是全无胃气，病多难治。